不可以用做根管充填的糊剂是
A. 氢氧化钙糊剂
B. 碘仿糊剂
C. 氧化锌丁香油糊剂
D. 钙维他糊剂
E. 氟化钠甘油糊剂

正确答案：E。氟化钠甘油糊剂

解析：氟化钠甘油糊剂是治疗牙本质过敏的药物，不符合根管充填糊剂的要求，因此不能用于根管充填。掌握“根管充填”知识点。